长期应用可与维生素K竞争性结合谷氨酸γ-羟化酶，导致出血的药品有
A. 利巴韦林
B. 头孢美唑
C. 拉氧头孢
D. 人促红素
E. 头孢米诺

正确答案：B、C、E。头孢美唑；拉氧头孢；头孢米诺

解析：本题考查药物不良反应。长时间、大剂量应用头孢菌素类（B对）、氧头孢烯类（C对）、头孢米诺（E对）等抗生素在肝脏微粒体中，与维生素K竞争性结合谷氨酸-γ羟化酶，可抑制肠道正常菌群，减少维生素K合成，导致维生素K依赖性凝血因子合成障碍而减少（低凝血酶原血症）而致出血。